根据《处方药与非处方药流通管理暂行规定》，销售处方药和甲类非处方药的零售药店必须
A. 具有《药品经营许可证》
B. 配备驻店执业药师或药师以上药学技术人员
C. 配备驻店药师
D. 配备驻店从业药师
E. 配备驻店财务人员

正确答案：A、B。具有《药品经营许可证》；配备驻店执业药师或药师以上药学技术人员

解析：本题考查药店零售管理。根据《处方药与非处方药流通管理暂行规定》，销售处方药和甲类非处方药的零售药店必须具有《药品经营许可证》（A对）、配备驻店执业药师或药师以上药学技术人员（B对）。《处方药与非处方药流通管理暂行规定》第三章药店零售第九条：销售处方药和甲类非处方药的零售药店必须具有《药品经营企业许可证》。销售处方药和甲类非处方药的零售药店必须配备驻店执业药师或药师以上药学技术人员。《药品经营企业许可证》和执业药师证书应悬挂在醒目、易见的地方。执业药师应佩戴标明其姓名、技术职称等内容的胸卡。